区别早期牙周炎与牙龈炎的最特征的标志是
A. 探诊≥3mm
B. 探诊出血
C. 牙龈松动
D. 咀嚼无力
E. 可否探及釉牙骨质界

正确答案：E。可否探及釉牙骨质界

解析：本题考查龈炎和早期牙周炎的区别。区别早期牙周炎与牙龈炎的最特征的标志是可否探及釉牙骨质界（E对）。牙龈炎和牙周炎不能通过探诊深度鉴别，牙龈炎症时探及龈袋，牙周炎症可探到深牙周袋，两者的区别不是牙周袋的深浅，而是上皮附着是否降低（A错），当牙龈炎症时，附着水平在釉牙骨质界；当牙周炎症时，附着水平位于釉牙骨质以下。牙龈炎症和牙周炎症探诊可能均有出血，不能用来鉴别牙周炎症和牙龈炎症（B错）。牙周炎症有支持组织的丧失，使咀嚼无力，牙龈炎症时由于炎性肿胀也可造成咀嚼无力（D错）。